可传递抑制信号的是
A. KIR
B. KAR
C. TCR
D. MBL
E. CEA

正确答案：A。KIR

解析：KIR（A对）是杀伤细胞免疫球蛋白样受体，属Ig超家族成员，传递抑制信号。KAR（B错）杀伤细胞活化受体，不能传递抑制信号。T淋巴细胞表面有多种表面标志，TCR-CD3复合分子为T细胞的特有标志，TCR（C错）接受APC细胞提呈的抗原，由CD3分子将抗原刺激的信号向细胞内转导MBL（D错）是指血浆中甘露糖结合的凝集素，可识别多种病原微生物表面的N氨基半乳糖或甘露醇，激活补体。CEA（E错）是肿瘤相关抗原，用于检测胃肠癌。